青年男性，腹痛，腹泻，脐周痛，大便不成形，无脓血有粘液，结肠镜检阴性，便后腹痛减轻，下列哪项体征有助于诊断
A. 大便不成形
B. 结肠镜检阴性
C. 腹痛腹泻
D. 无脓血有粘液
E. 排便与疼痛缓解有关

正确答案：E。排便与疼痛缓解有关

解析：几乎所有肠易激综合征病人都有不同程度的腹痛，部位不定，以下腹和左下腹多见，排便或排气后缓解（E对）。结肠镜检阴性不属于肠易激综合征的诊断标准（B错）。粪便性状异常属于肠易激综合征的常见症状（A错）。腹泻、黏液便属于常见症状但不是诊断所必备（CD错）。